病人男性，21岁，车祸头部外伤，昏迷30分钟后清醒，查体神志清楚，右颞头皮血肿，神经系统检查无阳性发现。入院观察，5小时后又转入昏迷，伴右侧瞳孔逐渐散大，左侧肢体瘫痪。临床诊断首先考虑是
A. 脑挫伤
B. 脑内血肿
C. 脑水肿
D. 急性硬脑膜下积液
E. 急性硬脑膜外血肿

正确答案：E。急性硬脑膜外血肿

解析：青年男性患者，头部外伤，昏迷30分钟后清醒，5小时后又转入昏迷（硬膜外血肿的典型表现），右颞头皮血肿，右侧瞳孔逐渐散大（提示右侧动眼神经受压），左侧肢体瘫痪（提示右侧脑功能区受压迫），结合患者病史、症状和查体所见，临床诊断首先考虑是右侧急性硬膜外血肿伴小脑幕切迹疝（E对）。脑挫伤（P188）（A错）常表现为伤后立即出现的意识障碍，无中间清醒期，一般不出现瞳孔改变和肢体偏瘫；脑内血肿（P194）（B错）常与伴有脑挫裂伤的急性硬膜下血肿同时存在，多见于对冲部位，偏瘫常于伤后立即出现；脑水肿（C错）主要表现为头痛、呕吐等颅内压增高的症状，一般不出现意识障碍、瞳孔改变等表现；硬脑膜下积液（D错）又称硬膜下水瘤，多为外伤后硬膜下腔出现的脑脊液积聚，可分为急性和慢性两种，以慢性者多见，多表现为逐渐加重的颅内压增高症状，无瘫痪、瞳孔改变。